下列说法属于颌面骨结核的临床表现的是
A. 局部红肿热痛，功能障碍
B. 全身症状严重
C. 脓性分泌物为翠绿色
D. 肿胀区表面皮肤和黏膜常表现为无化脓性感染的充血发红
E. 病变部位骨质塌陷，无压痛

正确答案：D。肿胀区表面皮肤和黏膜常表现为无化脓性感染的充血发红

解析：本题考查颌面部骨结核、放线菌病。骨结核一般为无症状的渐进性发展，偶有自发痛和全身低热（B错）。病变部位的软组织呈弥漫性肿胀，其下可扪及质地坚硬的骨性隆起，有压痛（E错），肿胀区表面皮肤和黏膜常表现为无化脓性感染的充血发红（D对）。颌骨结核可继发化脓性感染而出现局部红、肿、热、痛等急性骨髓炎的症状（A错），脓液也变成黄色黏稠（C错）。